整理资料是
A. 获得原始资料
B. 统计设计
C. 统计归纳，进行分组和汇总
D. 撰写文章
E. 计算统计指标，选择合适的检验方法并作出恰当的结论

正确答案：C。统计归纳，进行分组和汇总

解析：资料整理的目的是将搜集到的原始资料系统化、条理化，便于进一步计算统计指标和深入分析。包括审查与设计分组。分组方式常用质量分组（按属性和类别分组）与数量分组（按数值大小分组）。掌握“统计基本概念和步骤”知识点。